3095-96）》对几种污染物制定了限值
A. 2种
B. 4种
C. 6种
D. 8种
E. 10种

正确答案：E。10种

解析：本题考查环境空气质量标准的相关内容。我国的《环境空气质量标准（GB 3095-96）》对包括NO₂、铅、B（a）P、氟化物在内的10种（E对ABCD错）污染物制定了限值。